肾为气之根与肾的哪项功能有关
A. 藏精
B. 主水
C. 主纳气
D. 化生元气
E. 以上均非

正确答案：C。主纳气

解析：肾具有摄纳肺吸入的清气而维持正常呼吸的功能。肾气摄纳肺所吸入的自然界清气，保持吸气的深度，防止呼吸表浅。肺司呼吸，呼气赖肺气宣发，吸气赖肺气肃降。但吸气维持一定的深度，除肺气肃降作用外，还有赖于肾气的摄纳潜藏。《类证治裁·喘证》说：“肺为气之主，肾为气之根”（C对E错）。肾藏精是指肾贮存、封藏精气以主司人体的生长发育、生殖的生理功能（A错）。肾主水是指肾具有主持和调节人体水液代谢的功能（B错）。肾为脏腑之本，肾中精气阴阳对先天脏腑的生成和后天脏腑的功能具有重要的生理作用。肾气由肾精所化，又可分为肾阴、肾阳两部分，即元阴、元阳（D错）。